关于外用膏剂的基质对药物透皮吸引影响的叙述，错误的是
A. 基质的组成与皮脂分泌物相似时，有利于某些药物的透皮吸收
B. 聚乙二醇基质软膏中的药物释放较快且较易透皮吸收
C. 油脂性基质可增加皮肤的水合作用而提高药物的渗透性
D. 基质的pH小于弱酸性药物的Pka时可增加药物的吸收
E. 基质的pH大于弱碱性药物的Pka时可增加药物的吸收

正确答案：B。聚乙二醇基质软膏中的药物释放较快且较易透皮吸收

解析：本题考查外用制剂基质的组成与性质。关于外用膏剂的基质对药物透皮吸引影响的叙述，错误的是聚乙二醇基质软膏中的药物释放较快且较易透皮吸收（B错，为本题正确答案）。基质的组成与性质：①基质的组成、类型和性质：直接影响药物的释放、穿透和吸收。一般认为药物的吸收在乳状液型基质中最好，在吸水性软膏基质（凡士林加羊毛脂）、硅酮及豚脂中次之，在烃类基质中最差。若基质的组成与皮脂分泌物类似，则利于某些药物透过皮肤（A对）。水溶性基质聚乙二醇对药物的释放较快，但对药物的穿透作用影响不大，制成的软膏较难透皮吸收。②基质的pH：影响酸性和碱性药物的吸收。当基质pH小于弱酸性药物的pKa或大于弱减性药物的pKa时，药物的分子型显著增加而利于吸收（DE对）。③附加剂：基质中添加表面活性剂、透皮促进剂（如月桂氮酮）等能增加药物的穿透性，有利于吸收。④基质对皮肤的水合作用：增加皮肤的水合作用的基质，能增加药物的渗透性（C对）。其中油脂性基质封闭性强，可显著增加皮肤的水合作用。